凡是液滴或大颗粒的物质通过生物膜的方式
A. 简单扩散
B. 滤过
C. 主动转运
D. 载体扩散
E. 胞饮和吞噬

正确答案：E。胞饮和吞噬

解析：本题考查化学毒物通过生物膜的方式。凡是液滴或大颗粒的物质通过生物膜的方式为胞饮和吞噬（E对ABCD错）。